右上2缺失，间隙约2mm，右上3完好，牙槽骨正常，可选择
A. 种植固定桥
B. 固定-可摘联合桥
C. 半固定桥
D. 单端固定桥
E. 双端固定桥

正确答案：D。单端固定桥

解析：单端固定桥：又称悬臂固定桥。此种固定桥仅一端有固位体，桥体与固位体之间为固定连接。固定桥粘固在一端基牙上，桥体受力时由该端基牙承受，桥体另一端与邻牙接触或无邻牙接触，形成完全游离端。掌握“固定桥的组成和分类”知识点。